男，36岁。呕血1小时，患肝硬化门静脉高压症多年，查体：巩膜黄染，中等量腹水。血白蛋白25g/L，首先应选择的治疗方法是
A. 断流手术
B. 选择性门体分流术
C. 三腔二囊管压迫止血
D. 非选择性门体分流术
E. 经颈静脉肝内门体分流术

正确答案：C。三腔二囊管压迫止血

解析：中年肝硬化门脉高压症患者，突发呕血，应诊断为胃底食管静脉曲张破裂出血。患者巩膜黄染（黄疸）、血白蛋白25g/L（低白蛋白血症，正常值40～55g/L），提示肝功能差，应属Child-Pugh C级，不可采用断流手术（A错）、选择性门体分流术（B错）、非选择性门体分流术（D错）等手术治疗。三腔二囊管压迫止血（C对）是暂时控制出血的有效方法，是患者的首选治疗方法。经颈静脉肝内门体分流术（E错）适用于药物、内镜治疗无效，或等待肝移植的患者。